克罗恩病所见息肉主要是
A. 错构瘤性息肉
B. 管状腺瘤性息肉
C. 绒毛状腺瘤性息肉
D. 炎性息肉
E. 化生性息肉

正确答案：D。炎性息肉

解析：克罗恩病属于炎症性肠病，克罗恩病所见的息肉属于炎性息肉（D对）。错构性息肉（A错）是组织不正常发育形成的瘤样畸形，脂肪和钙化是其特征。管状腺瘤型息肉（B错）、绒毛膜腺瘤性息肉（C错）属于腺瘤，克罗恩病属于炎症性肠病，两者无关。化生性息肉（E错）是一种原因不明的黏膜增生性病变，与克罗恩病无关。